大动脉是指靠近心的动脉，其在结构和功能上有许多特征。引起大动脉被动回缩的主要结构是
A. 内皮下层
B. 环行平滑肌
C. 胶原纤维
D. 弹性膜
E. 基质

正确答案：D。弹性膜

解析：大动脉弹性膜（D对）丰富，有较大的弹性，可引起大动脉被动回缩。心室射血时，管壁被动扩张；心室舒张时，管壁弹性回缩，推动血液继续向前流动。